在遗传信息传递的各个水平上均可进行基因表达调控，但发生在哪个环节上，对基因表达起着至关重要的作用
A. 复制水平
B. 转录水平
C. 转录后水平
D. 翻译水平
E. 翻译后水平

正确答案：B。转录水平

解析：在遗传信息传递的各个水平上均可进行基因表达调控，但发生在转录水平，尤其是转录起始水平的调节，对基因表达起着至关重要的作用。掌握“基因表达调控原理”知识点。